下颌第三磨牙阻生，什么情况下适宜作龈瓣切除术
A. 水平阻生，冠周炎反复发作
B. 垂直阻生，升支前方有足够空隙，对（牙合）牙位置正常
C. 前倾阻生，前方邻牙远中龋坏
D. 前倾阻生，龈瓣上有咬痕
E. 颊向阻生，对牙位置正常

正确答案：B。垂直阻生，升支前方有足够空隙，对（牙合）牙位置正常

解析：本题考查龈瓣切除术的适应证。阻生磨牙有多种类型，如水平阻生、垂直阻生、颊向阻生、舌向阻生、前倾阻生、远中阻生、近中阻生等。龈瓣切除术可适用于需助萌的牙已达牙槽嵴顶部，切端在龈黏膜下，可被扪及，但因局部软组织致密，萌出困难者。冠周龈瓣切除术用于急性炎症消退后，对有足够萌出位置且牙位正常的智齿，可在局麻下行冠周龈瓣切除，以消除盲袋。垂直阻生，升支前方有足够空隙，对颌牙位置正常（B对）的患牙，其主要的萌出阻力来自软组织而非骨组织，故切除龈瓣可解除其所受到的阻力，阻生牙萌出后，可与对颌牙取得良好的对（牙合）关系。对于水平阻生，且冠周炎反复发作（A错）的患牙不适宜作龈瓣切除术，一方面是由于患牙无萌出的可能性，另一方面切除龈瓣仍能造成食物嵌塞而造成细菌感染。前倾阻生，前方邻牙远中龋坏（C错）的患牙虽可萌出，但萌出后的患牙与前方邻牙间往往有紧密的接触关系，且接触面不规则，食物嵌塞后不易清洁，会加重龋病的进展。龈瓣上有咬痕说明对颌牙有伸长或位置不正，即便阻生牙萌出后也不能与对（牙合）牙取得良好的对（牙合）关系，因此前倾阻生，龈瓣上有咬痕（D错）的患牙不宜行龈瓣切除术。颊向阻生，对牙位置正常（E错）的患牙进行龈瓣切除后，因颊向错位，即使萌出后也不能形成良好的咬合。